医学参考值范围一般是指某指标在
A. 所有人中的波动范围
B. 所有正常人中的波动范围
C. 绝大部分正常人中的波动范围
D. 少部分正常人中的波动范围
E. 一个人不同时间的波动范围

正确答案：C。绝大部分正常人中的波动范围

解析：本题考查医学参考范围的相关内容。医学参考值范围也称为正常值范围，是指大多数正常人的解剖、生理、生化、免疫等各种数据的波动范围（C对ABDE错）。所谓正常人，并非一定是“健康人”，而是指排除影响研究指标因素的同质人群。